调查发现某高原地区居民结肠癌的发病率高于全国平均水平，研究者注意到该地区人们的饮食习惯具有高脂肪摄入，低蔬菜、水果摄入的特点，拟开展一项课题研究，分析饮食习惯与结肠癌的关系，考虑到因果现象发生的时间顺序，最佳研究方法应为
A. 生态学研究
B. 横断面研究
C. 队列研究
D. 病例对照研究
E. 临床试验

正确答案：C。队列研究

解析：研究者拟开展的这项研究是为了观察饮食习惯（可疑病因）与结肠癌（疾病）的关系，为了检验病因假设，用的是分析性研究。分析性研究中时间顺序合理的是队列研究，它是将人群按是否暴露于某可疑因素分组，追踪各组的结局并比较其差异，属于前瞻性研究（C对）。生态学研究和横断面研究都属于描述性研究，用于提供病因线索（AB错）。病例对照研究是由“果”及“因”，检验病因的能力没有队列研究强（D错）。临床试验属于实验性研究，该类研究分析的是实验措施与观察结局之间是否有因果关联（E错）。